浆细胞
A. 是抗体产生细胞
B. 来源于活化的B细胞
C. 不再进一步分化
D. 可分化为记忆B细胞
E. 比未活化的B细胞体积大

正确答案：C。不再进一步分化